按照《药品说明书规范细则（暂行）》，中药复方制剂主要药味的排序要符合
A. 笔划数从少到多顺序
B. 药味的酸碱度递减规律
C. 药性的寒凉、温热顺序
D. 中医君臣佐使组方原则
E. 药材生长纬度递增原则

正确答案：D。中医君臣佐使组方原则